较常见子宫及输卵管畸形
A. 阴蒂肥大、大阴唇融合、阴唇粘连、处女膜闭锁、先天性前庭尿瘘与粪瘘、两性畸形
B. 有先天性无阴道、阴道横隔、阴道纵隔、阴道斜隔、阴道闭锁和狭窄等。治疗常延至青春期后做手术整形
C. 双子宫、纵隔子宫、单角子宫、双角子宫等
D. 雄激素不敏感综合征
E. 特纳综合征

正确答案：C。双子宫、纵隔子宫、单角子宫、双角子宫等

解析：本题考查较常见的子宫及输卵管畸形。子宫发育畸形包括单角子宫、残角子宫，双子宫、双角子宫、纵隔子宫（C对ABDE错）、弓形子宫、己烯雌酚所致的子宫发育异常等7种类型。